下述哪个结构与右侧旋前圆肌的活动有关
A. 右侧中央前回
B. 右侧内囊枕部
C. 右侧大脑脚底
D. 右侧皮质脊髓侧束
E. 右侧桡神经

正确答案：D。右侧皮质脊髓侧束

解析：同侧的皮质脊髓侧束支配同侧的四肢肌的随意运动，所以旋前圆肌的活动与右侧皮质脊髓侧束（D对）有关。